患者感染病原微生物后，血清中最早出现的特异性免疫球蛋白是
A. IgM
B. IgD
C. IgG
D. IgA
E. IgE

正确答案：A。IgM

解析：特异性免疫球蛋白是介导体液免疫的重要效应分子，是B细胞接受抗原刺激后增值分化为浆细胞所产生的糖蛋白，主要分为IgM、IgA、IgD、IgE、IgG。IgA（D错）（P36）的功能主要是参与黏膜免疫；IgM（A对）的功能是参与体液免疫的早期应答和进行早期防御；IgD（B错）（P37）的生物学功能尚不清楚，膜结合型IgD构成BCR，是B细胞分化发育成熟的标志；IgE（E错）（P37）的功能是参与Ⅰ型超敏反应和抗寄生虫反应。IgG（C错）（P35）的功能是参与体液免疫的再次应答和抗感染的作用，是机体抗感染的主力军，也是唯一一个可以通过血胎屏障的免疫球蛋白。